外感发热见
A. 额上热甚于手心热
B. 手心热甚于额上热
C. 手足背热甚于手足心
D. 手足心热甚于手足背
E. 尺肤部凉

正确答案：C。手足背热甚于手足心

解析：正常情况下，手足一般是温润的，诊手足寒温，对判断阳气存亡，推测疾病预后，具有重要意义，手足心与手足背比较，若手足背热甚者，多为外感发热（C对）。手心热与额上热比较，若额上热甚于手心热者为表热（A错）。手心热甚于额上热者为里热（B错）。手足心与手足背比较，手足心热甚于手足背，多为内伤发热（D错）。尺肤凉，而脉象细小者，多为泄泻、少气（E错）。